下面哪种论述是正确的
A. 高分子化合物的毒性主要取决于毒物在空气中的浓度和分散度
B. 高分子化合物的毒性主要取决于毒物所含游离单体的量和助剂的品种
C. 高分子化合物单体的毒性小于聚合物
D. 聚氯乙烯毒性大于氯乙烯
E. 高分子化合物的毒性只取决于毒物所含游离单位的量

正确答案：B。高分子化合物的毒性主要取决于毒物所含游离单体的量和助剂的品种